十二经脉之海是指
A. 督脉
B. 任脉
C. 冲脉
D. 带脉
E. 阴维脉

正确答案：C。冲脉

解析：冲脉涵蓄调节十二经气血，称十二经脉之海或血海（C对）。督脉调节全身阳经脉气，称“阳脉 之海”（A错）。任脉调节全身阴经脉气，称 “阴脉之海”（B错）。带脉为约束纵行躯干的诸条经脉（D错）。阴维脉调节六阴经经气（E错）。